下列经过斜角肌间隙的结构是
A. 锁骨下动脉
B. 锁骨下静脉
C. 锁骨上静脉
D. 腋动脉
E. 无

正确答案：A。锁骨下动脉

解析：经过斜角肌间隙的结构是锁骨下动脉（A对）和臂丛神经。